使用利尿药后期的降压机制是
A. 排Na⁺利尿，降低血容量
B. 降低血浆肾素活性
C. 增加血浆肾素活性
D. 减少细胞内Na⁺，降低血管对缩血管物质的反应性
E. 抑制醛固酮的分泌

正确答案：D。减少细胞内Na⁺，降低血管对缩血管物质的反应性